柴胡在补中益气汤中的配伍意义
A. 疏邪透表
B. 疏肝解郁
C. 升阳举陷
D. 升阳散火
E. 引药归经

正确答案：C。升阳举陷

解析：补中益气汤的功用为补中益气，升阳举陷。方中柴胡味辛、苦，性微寒。疏散退热，疏肝解郁，升举阳气。故方中配伍柴胡可升阳举陷。"（C对）。